下列哪项属于伤害的主动干预
A. 使用安全带
B. 在车辆设计中改善刹车
C. 安装安全气囊
D. 提高道路的安全性
E. 提高机动车的安全性

正确答案：A。使用安全带